将药物或药材提取物与适宜的亲水性基质及适宜辅料混匀后，涂布于裱背材料上制成的外用制剂，称为
A. 黑膏药
B. 糊剂
C. 巴布剂
D. 涂膜剂
E. 橡胶膏剂

正确答案：C。巴布剂